小儿消积止咳口服液除消积止咳外，又能
A. 驱虫
B. 清燥润肺
C. 清热肃肺
D. 清热凉肝
E. 泻火通便

正确答案：C。清热肃肺

解析：本题考查的是小儿消积止咳口服液的功能。小儿消积止咳口服液除消积止咳外，又能清热肃肺（C对）。小儿消积止咳口服液：【功能】清热肃肺，消积止咳。肥儿丸：【功能】健胃消积，驱虫（A错）。二母宁嗽丸：【功能】清肺润燥（B错），化痰止咳。小儿化食丸：【功能】消食化滞，泻火通便（E错）。功能为清热凉肝（D错）的中成药，2022年考试指南未明确说明。